盐酸吗啡的杂质是
A. 游离水杨酸
B. 对氨基苯甲酸
C. 酮体
D. 罂粟酸
E. 多环芳烃

正确答案：D。罂粟酸

解析：本题考查盐酸吗啡的特殊杂质。盐酸吗啡中的特殊杂质包括阿扑吗啡、罂粟酸（D对）和其他生物碱。